患者，女，19岁。月经不调，周期45～50天，经血量少，色黯有块，小腹冷痛，得热减轻，畏寒肢冷，舌暗苔白，脉紧。其诊断是
A. 血寒型虚寒性月经后期
B. 血寒型实寒性月经后期
C. 血寒型痛经
D. 虚寒型痛经
E. 肾阳虚型月经过少

正确答案：B。血寒型实寒性月经后期

解析：患者月经不调，周期45～50天，月经延期超过7天，且月经量少，色黯有块，小腹冷痛，得热痛减，是为寒症，畏寒肢冷，舌黯苔白，脉紧是是实寒之征（B对）。虚寒证月经后期多表现为小腹隐痛，喜暖喜按，腰酸无力，小便清长等肾阳虚之征（A错）。血寒形痛经多表现为经前或经期小腹冷痛拒按，得热痛减，月经或见退后，量少，经色黯而又瘀块，面色青白，肢体畏寒，舌黯苔白，脉沉紧（C错）。虚寒型痛经常见经前或经期小腹绵绵作痛，伴腰骶酸痛；经色黯淡，量少质稀；头晕耳鸣，面色晦暗，健忘失眠；舌质淡红，苔薄，脉沉细（D错），肾阳虚型月经过少多表现为月经素少或渐少，色黯淡，质稀；腰膝酸软，头晕耳鸣，足跟痛，或小腹冷，或夜尿多；舌淡，脉沉弱或沉迟（E错）。